犬吠样咳嗽多见于
A. 气胸
B. 气管异物
C. 大叶性肺炎
D. 胸膜炎
E. 肺脓肿

正确答案：B。气管异物

解析：咳嗽的音色对疾病的诊断有一定的提示意义。犬吠样咳嗽多见于喉头炎症水肿或气管受压、气管异物（B对）等。气胸（A错）、大叶性肺炎（C错）、胸膜炎（D错）、肺脓肿（E错）咳嗽音色无明显特异性。